恒牙列中患龋最多的是
A. 上颌第一前磨牙
B. 上颌第二前磨牙
C. 下颌第一前磨牙
D. 下颌第二前磨牙
E. 下颌第一磨牙

正确答案：E。下颌第一磨牙

解析：本题考查恒牙列的患龋率。恒牙列中，恒牙列中患龋最多的是下颌第一磨牙（E对）。其次是下颌第二磨牙、上颌第一磨牙、上颌第二磨牙、下颌第二前磨牙（D错）、上颌第二前磨牙（B错）、上颌第一前磨牙（A错）、下颌第一前磨牙（C错），下前牙患龋率最低。